热原的基本性质包括
A. 耐热性
B. 不挥发性
C. 水溶性
D. 滤过性
E. 被吸附性

正确答案：A、B、C、D、E。耐热性；不挥发性；水溶性；滤过性；被吸附性